外展并屈、伸肩关节的肌是
A. 斜方肌
B. 背阔肌
C. 胸大肌
D. 前锯肌
E. 三角肌

正确答案：E。三角肌

解析：斜方肌（A错）拉肩胛骨向脊柱靠拢。背阔肌（B错）使肩关节后伸、内收及旋内。胸大肌（C错）使肩关节内收、旋内和前屈。前锯肌（D错）拉肩胛骨向前并紧贴胸廓。三角肌（E对）使肩关节外展，前部肌束可以使肩关节屈和旋内，后部肌束能使肩关节伸和旋外。